颞颌关节关节盘最容易发生穿孔、破裂的部位是
A. 前带
B. 中间带
C. 后带
D. 双板区
E. 颞前附着区

正确答案：D。双板区

解析：本题考查关节盘最容易发生穿孔、破裂的部位。颞颌关节关节盘由前向后分为五部：前伸部、前带、中间带、后带和双板区。双板区位于后带上方，分为上下两板，上板由胶原纤维和弹力纤维构成，下板主要由胶原纤维构成。上下两板间含有疏松结缔组织，其内含有丰富静脉丛和神经，该处的神经受刺激，可产生关节疼痛。因双板区（D对）所承受的压力最大，故最容易发生穿孔、破裂。中间带（B错）是关节盘之最薄处，亦是关节盘穿孔的好发部位，仅次于双板区。前带（A错）和后带（C错）厚度大且受力小，故不易发生穿孔破裂。颞前附着区（E错）是关节盘附着在关节结节前斜面的前缘，是关节盘的附着结构，而不属于关节盘自身结构。